心衰时血容量增加的代偿反应可产生的负面影晌是
A. 水钠排出增加
B. 心输出量减少
C. 心脏前负荷过重
D. 心脏后负荷减少
E. 心室充盈不足

正确答案：C。心脏前负荷过重

解析：心衰时，机体可通过兴奋交感神经、激活肾素-血管紧张素-醛固酮系统、增加释放抗利尿激素等使肾脏重吸收钠水增多（A错），导致静脉回心血量增加，心室充盈增加（E错），前负荷增加。但长期血容量增加会导致心脏前负荷过重（C对），加重心衰。